用来说明暴露组由于某种暴露所致发病占全部发病的百分比的指标为
A. 相对危险度
B. 归因危险度
C. 归因危险度百分比
D. 发病密度
E. 人群归因危险度百分比

正确答案：C。归因危险度百分比

解析：本题考查归因危险度百分比。归因危险度百分比（C对ABDE错）是指暴露人群中的发病或死亡归因于暴露的部分占全部发病或死亡的百分比。